属于气滞血瘀临床表现的是
A. 唇甲色淡，胁下痞块，拒按，舌暗，脉沉涩
B. 胸胁胀闷窜痛，时轻时重，舌苔薄白，脉弦
C. 两胁胀闷窜痛，胁下痞块，舌略紫，脉涩
D. 面唇色淡白，疲乏无力，自汗，脉弱
E. 少气懒言，疲乏无力，自汗，舌淡，脉弱

正确答案：C。两胁胀闷窜痛，胁下痞块，舌略紫，脉涩

解析：“气滞血瘀证，指气滞和血瘀的证候兼并出现，临床以身体局部胀闷走窜疼痛，甚或刺痛，疼痛固定、拒按；或有肿块坚硬，局部青紫肿胀；或有情志抑郁，性急易怒；或有面色紫暗，皮肤青筋暴露；妇女可见经闭或痛经，经色紫暗或夹血块，或乳房胀痛；舌质紫暗或有斑点，脉弦涩等为辨证依据”，本题临床表现与之相符，两胁胀闷窜痛，为气滞表现，是由气机运行不畅所致；胁下痞块，舌略紫，脉涩，为血瘀表现，是由血液瘀积不行所致，故选项两胁胀闷窜痛，胁下痞块，舌略紫，脉涩，属于气滞血瘀的临床表现（C对）。唇甲色淡，为血虚表现，是由血液亏虚，脉络空虚，形体组织缺乏濡养荣润所致；胁下痞块，拒按，舌暗，脉沉涩，为血瘀表现，是由于血液淤积不散，不通则痛所致，故选项唇甲色淡，胁下痞块，拒按，舌暗，脉沉涩，属于血虚兼血瘀证的临床表现（A错）。胸胁胀闷窜痛，时轻时重，舌苔薄白，脉弦，为气滞的表现，是由气的运行发生障碍，气机不畅则胀闷，障碍不通则疼痛，气得运行则症减所致，故选项胸胁胀闷窜痛，时轻时重，舌苔薄白，脉弦，属于气滞证的临床表现(B错)。面唇色淡白，为血虚表现，是由血液亏虚，无以上荣面部所致；疲乏无力，自汗，为气虚表现，是由气虚致脏腑功能减退，卫外不固所致，故选项面唇色淡白，疲乏无力，自汗，脉弱，属于气血两虚证的临床表现（D错）。少气懒言，疲乏无力，自汗，舌淡，脉弱，为气虚的表现，是由气虚致脏腑功能衰退，卫外不固所致，故选项少气懒言，疲乏无力，自汗，舌淡，脉弱，属于气虚证的临床表现（E错）。